评定根管预备器械性能的指标如下，除外
A. 穿透力
B. 器械弹性
C. 侧壁切割力
D. 带碎屑能力
E. 工作端的长短

正确答案：E。工作端的长短

解析：本题考查评定根管预备器械性能的指标。器械工作端的长短（E错，为本题的正确答案）是器械的物理指标，不是判断器械性能的指标。根管机械预备是指采用根管切削器械对牙体组织进行切削、成形根管，以去除根管内感染物质，将根管预备成有利于冲洗、封药和充填的形态。常用的根管机械预备的器械为根管钻和根管锉。根管预备器械需要有以下性能：①穿透力（A对）强，有利于器械顺利到达到根尖位置。②器械弹性（B对）好，有利于器械进入根管，防止折断并降低根尖偏移的发生。③侧壁切割力（C对）强，可以更好的清除感染物质。④带碎屑能力（D对）强，可以防止堵塞根管，这些都是根管预备成功的关键。